女，38岁，已婚。右乳外上象限可触及一直径3cm包块，同侧腋窝触到肿大淋巴结，其它器官系统未见异常。若体检结果为T₂N₁M₀，按TNM分期法应属于
A. 0期
B. Ⅰ期
C. Ⅱ期
D. Ⅲ期
E. Ⅳ期

正确答案：C。Ⅱ期

解析：根据国际抗癌协会建议的TNM分期标准，可把乳腺癌分为以下各期：0期：TisN0M0；Ⅰ期：T1N0M0；Ⅱ期：T0～1N1M0，T2N0～1M0，T3N0M0；Ⅲ期：T0～2N2M0，T3N1～2M0，T4任何NM0；任何TN3M0；Ⅳ期包括M1的任何TN。根据分期标准，T2N1M0为Ⅱ期（C对）。